下面关于氯气中毒的描述不正确的是
A. 氯气的黏膜损伤作用是由于生成氯化氢和新生态氧
B. 高浓度可引起电击样死亡
C. 氯气也可引起慢性损伤
D. 氯气对呼吸道黏膜末梢感受器刺激可造成平滑肌痉挛
E. 心脏病患者可从事接触氯气的工作

正确答案：E。心脏病患者可从事接触氯气的工作